白细胞毒素是由下列哪一种牙周细菌所产生
A. 伴放线聚集杆菌
B. 二氧化碳噬纤维菌
C. 广溶血性链球菌
D. 齿垢密螺旋体
E. 牙龈卟啉单胞菌

正确答案：A。伴放线聚集杆菌

解析：本题考查重要的牙周致病菌。伴放线聚集杆菌因常与放线菌共生，故命名为伴放线放线杆菌，后又根据DNA同源性研究和rRNA序列分析，又将该菌归属于全新的聚集杆菌属，被命名为伴放线聚集杆菌，它们实质上是异名同菌，只是归属不同。伴放线聚集杆菌（伴放线放线杆菌）（A对）是唯一能分泌白细胞毒素的细菌，白细胞毒素可损伤人牙龈内和外周血中的中性粒细胞、单核细胞和淋巴细胞的细胞膜，导致白细胞死亡，释放溶酶体，造成牙周组织的破坏。二氧化碳噬纤维菌（B错）可产生多种蛋白酶，不能分泌白细胞毒素。广溶血性链球菌（C错）可分泌链球菌溶血素、透明质酸酶、链激酶等致病因子，不能产生白细胞毒素。齿垢密螺旋体（D错）有内毒素样物质，还可产生大量硫化氢和氨，并不能产生白细胞毒素。牙龈卟啉单孢菌（E错）可分泌大量的毒力因子，产生多种胞外蛋白酶（牙龈素、胶原酶）、内毒素、碱性磷酸酶、吲哚、有机酸等代谢产物，无白细胞毒素产生。